自牙颈部牙骨质，向牙冠方向展开，止于游离龈和附着龈的固有层的是
A. 龈牙组
B. 牙槽龈组
C. 环形组
D. 牙骨膜组
E. 越隔组

正确答案：A。龈牙组

解析：龈牙组：自牙颈部牙骨质，向牙冠方向散开，止于游离龈和附着龈的固有层，广泛地分布在牙龈固有层中，是牙龈纤维中最多的一组。掌握“牙龈”知识点。